以下根管治疗的非适应证中不包括
A. 在牙列中没有功能也没有修复价值的患牙
B. 隐裂牙行全冠修复之前
C. 患者开口受限，无法实施治疗操作
D. 患牙可疑为病灶感染的病原牙
E. 牙周情况差、缺少足够牙周组织支持的患牙

正确答案：B。隐裂牙行全冠修复之前

解析：本题考查根管治疗术概述。根管治疗术的非适应证：在牙列中没有功能也没有修复价值的患牙（A对）；牙周情况差、缺少足够牙周组织支持的患牙（E对）；患牙可疑为病灶感染的病原牙（D对）；患者开口受限，无法实施治疗操作（C对）；患者全身情况不佳，患有较严重全身系统性疾病，无法耐受治疗；患者不愿意接受根管治疗。而隐裂牙全冠修复之前（B错，为本题正确答案）是可以考虑进行根管治疗的。